女性.70岁，左侧腹股沟肿块三天，绞疼两天，查体：左侧腹股沟压痛，诊断
A. 腹股沟斜疝
B. 直疝
C. 股疝
D. 腹股沟肿块
E. 脂肪瘤

正确答案：C。股疝

解析：该患者女性，70岁（股疝多见于40岁以上妇女，女性骨盆宽大、联合肌腱和腔隙韧带较薄弱，以致股管上口宽大松弛而易发病。），左侧腹股沟肿块三天，绞疼两天（股疝发生嵌顿的表现），查体左侧腹股沟压痛（股疝的表现），结合患者的性别，年龄，表现和体征，可诊断为股疝（C对D错）。